4年前行破伤风自动免疫，受伤后作哪项处理可预防破伤风
A. 继续观察，暂不处理
B. 注射破伤风类毒素0.5ml
C. 注射TAT1000U
D. 注射TAT2000U
E. 注射TAT3000U

正确答案：B。注射破伤风类毒素0.5ml

解析：通过人工免疫，产生较稳定的免疫力是除早期彻底清创之外的另一重要的预防措施。自动免疫，即主动免疫（P118），采用破伤风类毒素作为抗原注射，使人体产生抗体以达到免疫目的。接受全程主动免疫者（免疫力可保持10年，以后间隔5～7年强化注射即可），伤后仅需肌内注射0.5ml类毒素（B对），即可在3-7日内形成有效的免疫抗体，不需注射破伤风抗毒素（TAT）（CDE错）。被动免疫法（P118）对伤前未接受自动免疫的伤员，尽早皮下注射破伤风抗毒素（TAT）1500-3000U。破伤风是一种极为严重的疾病，死亡率高，为此要采取积极的综合治疗措施（A错），包括清除毒素来源，中和游离毒素，控制和解除痉挛，保持呼吸道通畅和防治并发症等。